患者，女性，53岁。右上齿痛半年，隐隐作痛，时作时止，脉沉。针灸治疗在合谷、颊车、下关的基础上，应加取
A. 太冲、二间
B. 外关、风池
C. 风池、太冲
D. 风池、侠溪
E. 太溪、行间

正确答案：E。太溪、行间

解析：题干中患者齿痛半年，隐隐作痛，时作时止，脉沉为肾虚牙痛。可用太溪滋肾阴，行间清虚火治疗 肾阴虚牙痛（E对）。太冲、二间治疗胃火牙痛（A错）。外关、风池治疗风火牙痛（B错）。风池、太冲清肝胆火热，无补虚作用（C错）。风池、侠溪 泻肝胆火，用于实证（D错）。